脑和脊髓的被膜从外向内依次为
A. 硬膜、软膜和蛛网膜
B. 硬膜、蛛网膜和软膜
C. 软膜、蛛网膜、硬膜
D. 软膜、硬膜和蛛网膜
E. 蛛网膜、硬膜和软膜

正确答案：B。硬膜、蛛网膜和软膜

解析：脑和脊髓的三层被膜由外向内依次为硬膜、蛛网膜和软膜（B对），有支持、保护脑和脊髓的作用。